过敏性休克治疗的首选药物是
A. 三磷酸胞苷二钠
B. 氯化钙
C. 胞磷胆碱
D. 肾上腺素
E. 纳洛酮

正确答案：D。肾上腺素

解析：肾上腺素激动α受体，收缩小动脉和毛细血管前括约肌，降低毛细血管的通透性；激动β受体可改善心功能，缓解支气管痉挛；减少过敏介质释放，扩张冠状动脉，可迅速缓解过敏性休克的临床症状（D对）；三磷酸胞苷二钠用于颅脑外伤后综合症及其后遗症的辅助治疗（A错）；氯化钙用于治疗血钙过低所致的手足搐搦症、碱血症、原发性或继发性甲状旁腺功能低下症以及肠绞痛、输尿管绞痛等（B错）；胞磷胆碱用于颅脑手术和脑外伤引起的意识障碍。其他中枢神经系统急性损伤引起的功能和意识障碍（C错）；纳洛酮可以用来拮抗由于服用麻醉性镇痛药物而导致的呼吸抑制；其次，可以使患者变得清醒，临床上多用来治疗昏迷病人（E错）。